婴儿，3个月。体重6kg，人工喂养。每天应喂牛奶量及加糖量分别为
A. 360ml，24g
B. 480ml，32g
C. 540ml，36g
D. 660ml，40g
E. 720ml，48g

正确答案：D。660ml，40g

解析：婴儿体重6kg，需牛奶110ml×6为660ml，加糖量应在660ml×5%为33g或者660ml×8%为52.8g，加糖量范围为33g-52.8g（D对）。360ml牛奶量太少，其糖量虽正确，却无法保证营养的充足（A错）。480ml牛奶量亦太少（B错）。540牛奶量也不够（C错）。720ml牛奶量太多，超过婴儿消化能力，易致积食、腹泻等（E错）。